对类风湿关节炎的最初治疗，除一般治疗法外，常用基本治疗药物是
A. 抗疟药
B. 磺胺药
C. 水杨酸制剂
D. 抗生素
E. 糖皮质激素

正确答案：C。水杨酸制剂

解析：水杨酸制剂的作用机理主要为抑制环氧化酶使前腺素生成受抑制而起作用，以达到消炎为止痛的效果。但不能阻止类风湿性关节炎病变的自然过程（C对）。用来治疗风湿性疾病的抗疟药，仅指喹啉类化合物，它们具有抗炎免疫抑制的作用，不是类风湿性关节炎的基本治疗药物（A错）。磺胺药是一类人工合成的广谱抗菌药，如柳氮磺吡啶是治疗类风湿关节炎的有效药物，但不是类风湿性关节炎的常用药物（B错）。抗生素主要是针对细菌感染产生的炎症有效。类风湿关节炎应用抗生素治疗是无效的（D错）。糖皮质激素能够迅速地减轻关节疼痛肿胀，在关节炎急性发作或伴有心、肺、眼和神经系统等器官受累的重症患者，给予短效激素。或经正规慢作用抗风湿药治疗无效的患者，局部使用可在关节腔内注射有缓解关节的炎症的作用（E错）。